组成人体运动系统的主要有
A. 血管、肌肉、关节
B. 血管、肌肉、骨骼
C. 血管、骨骼、关节
D. 骨骼、肌肉、关节
E. 骨骼、肌肉、韧带

正确答案：D。骨骼、肌肉、关节